前庭蜗神经经过
A. 舌下神经管
B. 颈静脉孔
C. 内耳门
D. 枕内嵴
E. 枕骨大孔

正确答案：C。内耳门

解析：前庭蜗神经经过内耳门入颅，伴前庭神经入脑（C对）。舌下神经经舌下神经管出颅（A错）。颈内静脉于颈静脉孔处续于乙状窦（B错）。